下列用于大众的健康教育的材料是
A. 宣传单
B. 折页
C. 海报
D. 手机短信
E. 报纸

正确答案：E。报纸